男，40岁，间断上腹痛3年，加重1周，1周前上腹胀痛明显，进食后加重，伴恶心，呕吐，呕吐物量大，有酸臭味，呕吐后症状有所缓解，排便排气较前减少，最可能的体征
A. 腹肌紧张
B. 液波震颤阳性
C. 肠型
D. 振水音阳性
E. 肠鸣音减弱

正确答案：D。振水音阳性

解析：中年男性患者，间断上腹痛3年，加重1周，1周前上腹胀痛明显，进食后加重，伴恶心，呕吐，呕吐物量大，有酸臭味，呕吐后症状有所缓解（典型幽门梗阻表现），排便排气较前减少，故其最可能的体征振水音阳性（D对）。腹肌紧张一般见于腹膜炎等（A错）。液波震颤阳性一般见于有大量腹水病人，腹水达到3000ml-4000ml以上才能检出（B错）。肠型一般可见于绞窄性肠梗阻、结肠梗阻等（C错）。肠鸣音减弱一般可见于血运性肠梗阻等（E错）。